女，28岁，经产妇，人工流产2次。妊娠37周，晨起发现阴道流血，多于月经量，无腹痛。查体：P80次/分，BP110/70mmHg，胎方位LOA，头浮，胎心率150次/分，耻骨联合上可闻及血管音。本例最适合的处理是
A. 给予子宫收缩剂
B. 严密观察，等待自然临产
C. 人工破膜
D. 行剖宫产术
E. 产钳助娩

正确答案：D。行剖宫产术

解析：成年女性患者，经产妇，有多次流产史的高危因素。妊娠晚期（妊娠28周～40周），晨起发现阴道流血，多于月经量，无腹痛。查体：血压下降，BP110/70mmHg（正常值90～120/60～80mmHg），胎位异常，头浮（提示胎先露），耻骨联合上可闻及血管音。综合患者的症状、体征和辅助检查，初步诊断为前置胎盘，本例最适合的处理是行剖宫产术（D对）。给予子宫收缩剂（A错）、严密观察，等待自然临产（B错）、人工破膜（C错）、产钳助娩（E错）仅适用于边缘性前置胎盘、低置胎盘、枕先露、阴道流血少，估计在短时间内能结束分娩者，在有条件的机构，备足血源的前提下。